男性，28岁。反复中上腹痛年余，伴腹泻，反酸嗳气明显，曾做胃镜检查见胃、十二指肠及球后多发溃疡，服西咪替丁疗效不明显，粪检（﹣），血清促胃液素500pg/ml，腹泻的原因可能为
A. 胃泌素瘤
B. 甲状腺功能亢进
C. 霍乱
D. 吸收不良综合征
E. 急性胃肠炎

正确答案：A。胃泌素瘤